使用清开灵注射液发生严重不良反应时可见
A. 急性肾功能损害、皮疹、头晕、胃肠道反应、过敏样反应
B. 肝肾功能异常、粒细胞、白细胞和血小板减少、精子数量减少
C. 肝损害、剥脱性皮炎
D. 胰腺炎、低钾血症、低氯血症、低钠血症
E. 过敏性休克、急性喉头水肿、过敏性哮喘、过敏性间质性肾炎

正确答案：E。过敏性休克、急性喉头水肿、过敏性哮喘、过敏性间质性肾炎

解析：本题考查的是清开灵注射液的不良反应表现。使用清开灵注射液发生严重不良反应时可见过敏性休克、急性喉头水肿、过敏性哮喘、过敏性间质性肾炎（E对）。清开灵注射液的不良反应表现：以各种类型过敏反应为主，严重过敏反应包括过敏性休克、急性喉头水肿、过敏性哮喘，过敏性间质性肾炎。急性肾功能损害、皮疹、头晕、胃肠道反应、过敏样反应（A错）为莲必治注射液的不良反应表现。莲必治注射液的不良反应表现：表现为急性肾功能损害、皮疹、头晕、胃肠道反应、过敏样反应等。肝肾功能异常、粒细胞、白细胞和血小板减少、精子数量减少（B错）为雷公藤制剂的不良反应表现。雷公藤制剂的不良反应表现：药物性肝炎、肾功能不全、粒细胞减少、白细胞减少、血小板减少、闭经、精子数量减少、心律失常等；严重者有肝肾功能异常、肾功能衰竭、胃出血等。肝损害、剥脱性皮炎（C错）为克银丸的不良反应表现。克银丸的不良反应表现：肝损害、剥脱性皮炎。胰腺炎、低钾血症、低氯血症、低钠血症（D错）为珍菊降压片的不良反应表现。珍菊降压片的不良反应表现：消化系统表现为肝功能异常、黄疸、胰腺炎等；精神神经系统表现为头晕、视物模糊、运动障碍、麻木；皮肤及附件损害表现为剥脱性皮炎、全身水疱疹伴瘙痒等；代谢和营养障碍表现为低钾血症、低氯血症、低钠血症；有肾功能异常、心前区疼痛、心律失常、白细胞减少等个例报告。